关于深静脉血栓形成的说法，正确的有
A. 依诺肝素应皮下注射，避免肌内注射
B. 服用华法林，需要监测INR
C. 肾功能不全者，慎用依诺肝素
D. 服用利伐沙班，需要监测INR
E. 定期检查血常规和粪隐血

正确答案：A、B、C、E。依诺肝素应皮下注射，避免肌内注射；服用华法林，需要监测INR；肾功能不全者，慎用依诺肝素；定期检查血常规和粪隐血

解析：本题考查深静脉血栓形成（DVT）的用药注意事项与患者教育。开始使用华法林时需要每周监测2～3次INR（B对），稳定后每个月监测1次。使用普通肝素或低分子肝素抗凝治疗时，宜选择皮下注射，应避免肌内注射（A对），以防止形成血肿。间断检查血常规、粪隐血（E对）、尿常规，并注意皮肤黏膜的出血、淤血和咯血等情况。肾功能不全者慎用小分子肝素（如依诺肝素）（C对）。